与利尿药联合可以应用于急性肾衰的药物是
A. 去甲肾上腺素
B. 肾上腺素
C. 多巴胺
D. 异丙肾上腺素
E. 乙酰胆碱

正确答案：C。多巴胺

解析：多巴胺与利尿剂联合应用于急性肾衰。对急性心功能不全，具有改善血流动力学的作用。掌握“多巴胺和异丙肾上腺素”知识点。